减压病的治疗措施主要是
A. 加压
B. 减压
C. 给氧
D. 综合治疗
E. 对症治疗

正确答案：A。加压